男，20岁，坚持认为自己的父亲已经被人害死了，而那个朝夕陪伴自己的父亲只是看起来像父亲的一个人冒充的，家人劝说也不改变他的看法。该患者最可能的症状是
A. 近事遗忘
B. 虚构
C. 错构
D. 远事遗忘
E. 妄想

正确答案：E。妄想

解析：患者青年男性，坚信与事实不符、缺乏客观现实基础的事情，最可能的症状是妄想（E对）。虚构（B错）指在遗忘的基础上，患者以想象的、未曾亲身经历的事件来填补记忆的缺损，虚构内容自己也不能再记住，所以其叙述的内容常常变化，且容易受暗示的影响。错构（C错）指在遗忘的基础上，患者对过去所历过的事件，在发生的地点、情节、特别是在时间上出现错误的回忆，并坚信不移（P21）。